血肿形成通常在伤后
A. 1～4小时
B. 2～6小时
C. 3～7小时
D. 4～8小时
E. 5～9小时

正确答案：D。4～8小时

解析：血肿形成：骨折时，由于骨折部骨髓、骨膜及周围软组织中的血管断裂出血，形成血凝块。通常在伤后4～8小时即可在两断端间形成血肿。掌握“颧骨及颧弓、眼眶骨折及骨折愈合过程”知识点。